焚烧法适用于处理何种工业废物
A. 含汞化合物
B. 含氰化合物
C. 含铬化合物
D. 含镉化合物
E. 工业废渣

正确答案：B。含氰化合物

解析：本题考查焚烧法。焚烧法是高温分解和深度氧化的综合过程。通过焚烧使可燃性的工业废渣氧化分解，达到减少容积，去除毒性，回收能量及副产品的目的。焚烧法主要用于处理含有有毒物质的废物，如含氰化合物（B对ACDE错）的废物。氰化物是一类有毒物质，其中的氰化物可以通过焚烧法转化为更安全的物质，从而减少对环境的污染。